晚发型硅沉着病是指
A. 接触矽尘20年后才出现的硅沉着病
B. 矽尘作业工人在50岁以后出现的硅沉着病
C. 脱离矽尘作业后即出现的硅沉着病
D. 脱离矽尘作业若干年后才发现的硅沉着病
E. 以上都不是

正确答案：D。脱离矽尘作业若干年后才发现的硅沉着病